男，58岁，患肝炎已10余年，因无力、纳差、腹胀20天诊断为肝炎后肝硬化（失代偿期）入院。肝功能试验显著异常，其中白蛋白降低，球蛋白增高，白蛋白/球蛋白比率倒置。为治疗低蛋白血症，首选的血液制品是
A. 全血
B. 新鲜冰冻血浆
C. 普通冰冻血浆
D. 冷沉淀
E. 白蛋白

正确答案：E。白蛋白

解析：患者为肝硬化失代偿期引发的低蛋白血症。为治疗低蛋白血症，首选的血液制品为白蛋白（E对）。全血（A错）常用于解决患者术中或急性失血导致的低血容量性休克；新鲜冰冻血浆（B错）、普通血浆（C错）、冷沉淀（D错）三者均为血浆成分，可以有效缓解患者因肝功能障碍而致的凝血功能异常，但不能治疗低蛋白血症。